能够避免药物受胃肠液及酶的破坏而迅速起效的片剂是
A. 肠溶片
B. 分散片
C. 泡腾片
D. 舌下片
E. 缓释片

正确答案：D。舌下片

解析：本题考查片剂。舌下片（D对）经舌下黏膜迅速吸收，不经过胃肠道，可以避免药物受胃肠液及酶的破坏；肠溶片（A错）在肠中定位释放；分散片（B错）需要经胃肠道吸收；泡腾片（C错）如口服，则会进入胃肠道；缓释片（E错）为口服药物，以上四种均受会到胃肠液及酶的破坏。